有关残髓炎临床表现的说法中，正确的是
A. 有牙髓治疗史
B. 强温度刺激可引起患牙迟缓性痛
C. 再治疗时探查根管内有疼痛感觉即可确诊
D. 患牙治疗后近期或远期又出现慢性牙髓炎的症状
E. 以上说法均正确

正确答案：E。以上说法均正确

解析：残髓炎临床表现：①有牙髓治疗史，患牙牙冠见有做过牙髓治疗的充填体或暂封材料。②患牙治疗后近期或远期又出现慢性牙髓炎的症状，如自发性钝痛、放散性隐痛、温度刺激痛等，常有咬合不适或轻咬合痛。③强温度刺激可引起患牙迟缓性痛，叩痛（+）或（±）。④再治疗时探查根管内有疼痛感觉即可确诊。掌握“残髓炎及逆行性牙髓炎”知识点。